甘遂与大戟的共同功效是
A. 泻水逐饮
B. 去积杀虫
C. 峻下冷积
D. 活血化瘀
E. 润燥软坚

正确答案：A。泻水逐饮

解析：本题考查甘遂与京大戟（大戟）的功效及鉴别，两者均为峻下逐水药，都具有泻水逐饮（A对）的功效，去积杀虫是牵牛子具有而甘遂与京大戟都不具备的功效（B错）；峻下冷积是巴豆霜具备而甘遂与京大戟都不具备的功效（C错）；活血化瘀，润燥软坚是甘遂与京大戟都不具备的功效（DE错）。